下列X线征象是周围型肺癌的特征是
A. 肺段或肺叶的局限性肺气肿
B. 圆形或类圆形肿块呈分叶状，有脐样切迹会有毛刺
C. 阻塞性肺炎
D. 出现囊状空洞或斑片状浸润
E. 可有S形的肺不张和密度较高的片状阴影

正确答案：B。圆形或类圆形肿块呈分叶状，有脐样切迹会有毛刺

解析：周围型肺癌的X线表现为局灶的圆形或类圆形高密度影，边缘呈分叶状，有脐样切迹或有毛刺（B对）。ACDE均为中央型肺癌特征性X线表现。中央型肺癌的癌肿向管腔内生长可引起支气管阻塞征象，阻塞不完全时呈现肺段或肺叶的局限性肺气肿（A错）；完全阻塞时，表现为段、叶不张。肺不张伴有肺门淋巴结肿大时，下缘可表现为倒S状影像。支气管阻塞后易导致远端肺组织感染，引起阻塞性肺炎（C错），炎症部位表现为密度较高的片状阴影（E错）。炎症进一步发展，病情严重者可能引起肺脓肿，X线片可出现囊状空洞或斑片状浸润影（D错）。